以下各项中不适合采取第一级预防的是
A. 糖尿病
B. 病因不明的疾病
C. 脑卒中
D. 心血管疾病
E. 职业病

正确答案：B。病因不明的疾病

解析：第一级预防为病因预防，是通过采取措施消除致病因素对机体危害的影响或提高机体的抵抗力来预防疾病的发生，因此对于病因不明的疾病无法采取措施消除致病因素来预防疾病的发生，即不适合采取第一级预防（B错，为本题正确答案）。糖尿病（A对）、脑卒中（C对）、心血管疾病（D对）、职业病（E对）均有已知的病因或危险因素，可以采取第一级预防。